棘层内疱常见于
A. 肉芽肿性唇炎
B. 扁平苔藓
C. 天疱疮
D. 红斑
E. 白斑

正确答案：C。天疱疮

解析：棘层内疱：疱在上皮的棘层内或在基底层之上，有棘层松解，上皮细胞失去黏附力而彼此分离。见于天疱疮，也见于病毒性水疱。掌握“口腔黏膜基本病理变化”知识点。